患者胸胁灼痛，头晕口苦，急躁易怒，舌红，其脉象应是
A. 滑数
B. 数而有力
C. 细数
D. 弦数
E. 洪数

正确答案：D。弦数

解析：患者胸胁灼痛，头晕口苦，急躁易怒，舌红，属于肝火炽盛证，故脉弦数（D对）。